医学道德评价的方式是依靠
A. 社会舆论媒体介入传统习俗
B. 自我认识内心信念传统习俗
C. 社会舆论内心信念传统习俗
D. 社会舆论内心信念媒体介入
E. 内心信念传统习俗自我认识

正确答案：C。社会舆论内心信念传统习俗

解析：医学道德评价的方式社会舆论、传统习俗和内心信念（C对）。医务人员的内心信念是指发自内心地对医德原则、规范和理想的正确性和崇高性的笃信，以及由此而产生的实现医德义务的强烈责任感。它通过道德良心发挥自律作用，能促进医务人员自觉地进行善恶评价和行为选择。社会舆论是指公众对某种社会现象、事件或行为的看法和态度。社会舆论是社会道德评价的主要方式，是一种精神力量，对于敦促医务人员履行医德义务具有特殊的作用。传统习俗指人们在长期社会生活中逐步形成和沿袭下来的一种稳定的、习以为常的行为倾向。在种种传统习俗中，只有那些涉及患者健康利益、体现医务人员职业道德价值观念的习俗，才是医德评价时应该考虑的。